男，55岁，左上腹疼痛，血压80/55mmhg，Hb106g/L，下列处理不正确的是
A. 广谱抗生素
B. 维持水电解质平衡
C. 查找病因
D. 完善相关检查
E. 输血

正确答案：E。输血

解析：休克时液体种类的选择原则上是，经静脉快速滴注平衡盐溶液和人工胶体液根据题干Hb：106g/L暂不需要输血（E错，为本题正确答案）。休克时需要及时控制炎症扩散，防止进一步感染（A对）。在休克纠正过程中，应重视纠正酸中毒，适时静脉给予碳酸氢钠，同时要注意电解质紊乱的发生，防止血电解质离子过高或过低，以免引起心律失常，心肌收缩力下降，酸碱平衡失调，难以纠正细胞水肿和脱水的情况（B对）。出现休克时，在用平衡补液盐补充血容量的同时要及时完善相关检查及查找病因，必要时需要进行急诊手术治疗（CD对）。